男，35岁。间断腹痛、腹泻2年。受凉后加重，大便2～4次/日，多为不成形便，时带黏液，排便后腹痛可缓解，体重无明显变化。平素少量饮酒。结肠镜检查无异常。最可能的诊断是
A. 慢性胰腺炎
B. 功能性消化不良
C. 酒精性肝硬化
D. 肠易激综合征
E. 肠道病毒感染

正确答案：D。肠易激综合征

解析：中年男性患者，间断腹痛、腹泻2年 （病程6个月以上），受凉后加重（精神、饮食等因素常诱使肠易激综合征症状复发或加重），大便2～4次/日（排便频率异常），多为不成形便，时带黏液（粪便性状异常），排便后腹痛可缓解（符合肠易激综合征的腹痛特点），体重无明显变化。结肠镜检查无异常（肠易激综合征为功能性肠病，无器质性病变）。综合该患者的病史、实验室及结肠镜检查，考虑诊断为肠易激综合征（D对）。慢性胰腺炎（P436）（A错）常有反复发作的上腹痛，平卧位加重，前倾坐位、弯腰、侧卧卷曲时疼痛可减轻，并伴有腹泻、消瘦。功能性消化不良（P384）（B错）多有上腹痛，常与进食有关，排便后不能缓解。酒精性肝硬化（P393）（C错）常有大量饮酒史，有肝功能减退和门静脉高压的症状。肠道病毒感染（E错）导致的腹泻可见脓血便，大便隐血试验阳性。